对10名25岁以上的山区健康男子测量脉搏次数（次/分），用t检验与全国正常男子资料进行比较，按a=0.05的检验水准，自由度为
A. V=9
B. V=19
C. V=8
D. V=20
E. V=18

正确答案：A。V=9

解析：本题通过t检验对山区健康男子测量脉搏次数（次/分）与全国正常男子资料进行比较，属于单样本的t检验，通过公式中v（自由度）=n（样本个数）-1可算得本次统计资料自由度=10-1=9（A对）。